需进行人体试用试验的化妆品是
A. 用于眼部的化妆品
B. 婴幼儿使用的化妆品
C. 脱发类化妆品
D. 长期使用的化妆品
E. 含生物活性物质的化妆品

正确答案：C。脱发类化妆品

解析：本题考查需进行人体试用试验的化妆品。需进行人体试用试验的化妆品有健美类、美乳类、育发类和脱毛类化妆品（C对ABDE错）。